通常反映社会经济发展综合性最强的指标是
A. 人均GDP
B. GDP
C. 出生率
D. 死亡率
E. 平均期望寿命

正确答案：E。平均期望寿命